婴儿肠套叠的三大典型临床表现是
A. 腹痛、血便、腹部肿块
B. 腹痛、哭闹、腹部肿块
C. 腹痛、呕吐、腹部肿块
D. 腹痛、血便、呕吐
E. 腹痛、腹胀、呕吐

正确答案：A。腹痛、血便、腹部肿块

解析：肠套叠是指肠的一段套入其相连的肠管腔内，多见于婴幼儿，其三大典型症状腹痛、血便和腹部肿块（A对）。